患儿，3个月，易激惹，烦躁多哭，夜寐不安，多汗，摇头擦枕，生长发育与同龄儿相同，X线骨骼检查正常，实验室检查：血清总钙及血磷偏低，钙磷乘积36，碱性磷酸酶稍有增高。初步诊断为维生素D缺乏性佝偻病，其分期是
A. 活动早期
B. 活动期
C. 恢复期
D. 后遗症期
E. 以上均非

正确答案：A。活动早期

解析：本患儿已被明确诊断为维生素D缺乏性佝偻病。维生素D缺乏性佝偻病分为初期（早期）、激期（活动期）、恢复期和后遗症期。其中初期常见于3～6个月内的小婴儿，主要表现为神经兴奋性增高，如有烦躁、睡眠不安、易惊、夜啼、多汗等症，并可致枕部脱发而见枕秃；血生化改变轻微，血清25-（OH）D3下降，血钙正常或略下降，血磷降低，碱性磷酸酶正常或稍高，骨骼X线摄片可无异常，或见临时钙化带稍模糊。根据该患儿发病年龄、临床症状、体征以及实验室检查结果，可确定其分期为初期（旧教材表述为活动早期）（A对）。活动期又叫激期，主要表现为骨骺变化和运动机能发育迟缓（B错），其中，骨骼改变包括颅骨软化、方颅、臀形颅；囟门较大且闭合延迟；肋骨串珠状，鸡胸畸形，漏斗胸；“手镯”及“脚镯”改变，膝内翻（“O”型）或膝外翻（“X”型）等。肌肉改变包括全身肌肉松弛、乏力、肌张力降低，坐、立、行等运动功能发育落后，腹肌张力低下，腹部膨隆如蛙腹。活动期的血生化及骨骼X线片也明显异常：血清25-（OH）D3更加下降，血钙正常或下降，血磷下降，碱性磷酸酶明显升高，长骨片显示骨骺端钙化带消失，呈杯口状、毛刷状改变，骨骺软骨带增宽。至恢复期（C错），临床症状和体征均逐渐减轻、消失，血生化逐渐恢复正常，骨骼X线片出现不规则钙化线。后遗症期（D错）时，临床症状消失，血生化和X线摄片正常，只有重症佝偻病可残留不同程度的骨骼畸形，多见于2岁以上儿童。